下呼吸道包括
A. 咽腔
B. 喉腔
C. 气管
D. 肺泡
E. 肺血管

正确答案：C。气管

解析：气管（C对）和各级支气管为下呼吸道。